男，22岁。上课时突然手中钢笔掉落，两眼向前瞪视，呼之不应，持续数秒钟。过后对上述情况全无记忆，以后反复有类似发作，有时1天发作几次。发作首选用药
A. 丙戊酸钠
B. 卡马西平
C. 乙琥胺
D. 苯妥英钠
E. ACTH

正确答案：A。丙戊酸钠

解析：失神发作特征性表现是突然短暂的（5~10秒）意识丧失和正在进行的动作中断，双眼茫然凝视，呼之不应...伴失张力如手中持物坠落或轻微阵挛，一般不会跌倒，事后对发作全无记忆，每日可发作数次至百次。发作后立即清醒，无明显不适，可继续先前活动。醒后不能回忆，故考虑诊断为失神发作，单纯失神发作首选丙戊酸钠，不是乙琥胺（A对C错）。卡马西平（B错）是癫痫复杂部分性发作的首选药物。苯妥英钠（D错）对特发性癫痫综合征合和部分性发作有效，可加重失神和肌痉挛发作，故不可用于全身强直-阵挛性发作和失神发作合并发生，一般不作为癫痫用药的首选。